关于牙齿的发生不正确的是
A. 成釉器形成釉质
B. 牙乳头形成牙本质、牙骨质
C. 牙囊形成牙周膜
D. 牙乳头形成牙髓
E. 牙囊形成固有牙槽骨

正确答案：B。牙乳头形成牙本质、牙骨质

解析：牙胚由成釉器、牙乳头和牙囊构成。牙胚将形成4种牙体组织和部分牙周组织，其中成釉器形成釉质，牙乳头形成牙本质和牙髓，牙囊形成牙骨质、牙周膜和部分牙槽骨。掌握“牙胚的发生及分化”知识点。